真热假寒的病机是
A. 阴盛格阳
B. 阳盛格阴
C. 阳虚则寒
D. 阴盛则寒
E. 阴损及阳

正确答案：B。阳盛格阴

解析：本题考查的是阳盛格阴。真热假寒的病机是阳盛格阴（B对）。阴阳格拒：阴阳格拒，是阴阳失调病机中比较特殊的一类病机。形成阴阳相互格拒的机制，主要是在病变过程中阴或阳的一方偏盛至极，或阴和阳的一方极端虚弱，双方盛衰悬殊，盛者壅遏于内，将虚弱、不足的一方排斥格拒于外，迫使阴阳之间不相维系，从而出现真寒假热或真热假寒的复杂病变现象，即阴阳格拒。（1）阴盛格阳（A错）：阴盛格阳，是指阴寒之邪壅盛于内，逼迫阳气浮越于外，使阴阳之气不相顺接、相互格拒，表现为真寒假热的病机变化。病变本质是阴寒内盛，临床可见四肢厥逆、下利清谷、脉微欲绝等症状；又可见阳浮于外，症见身热反不恶寒（但欲盖衣被）、面颊泛红等假热之象。（2）阳盛格阴：阳盛格阴，是指邪热过盛，深伏于里，阳气被遏，郁闭于内，不能外透布达于肢体，从而形成阴阳排斥，而格阴于外，表现为真热假寒的病机变化。病变本质是阳热内盛，临床可见身热、面红、气粗、烦躁等症状外；又突然出现四肢厥冷（但身热不恶寒）、脉象沉伏（但沉数有力）等假寒之象。阳虚则寒（C错）指阴阳偏衰。阴阳偏衰：阴或阳的偏衰，是指“精气夺则虚”的虚证。“精气夺”，实质上是包括了机体的精、气、血、津液等基本物质的不足及其生理功能的减退，同时也包括了脏腑、经络等生理功能的减退和失调。阴盛则寒（D错）指阴阳偏盛。阴阳偏盛：又称“阴阳偏胜”，阴或阳的偏盛，主要是指“邪气盛则实”的实证。病邪侵入人体，必从其类。阳邪侵入人体，可形成阳偏盛，阴邪侵入人体，可形成阴偏盛。阳盛则热，阴盛则寒，明确地指出了阳偏盛和阴偏盛病机的临床表现特点。阴损及阳（E错）：是指由于阴气亏损，累及阳气生化不足，或阳气无所依附而耗散，从而在阴虚的基础上又出现了阳虚，形成以阴虚为主的阴阳两虚的病机变化。